流行性乙型脑炎的传染源是
A. 羊
B. 犬
C. 啮齿动物
D. 猪
E. 病人

正确答案：D。猪

解析：乙脑是人畜共患的自然疫源性疾病，人与许多动物（如猪、牛、马、羊、鸡、鸭、鹅等）都可成为本部的传染源。人被乙脑病毒感染后，可出现短暂的病毒血症，但病毒数量少、且持续时间短，所以人不是本病的主要传染源。动物中的家畜、家禽和鸟类均可感染乙脑病毒，特别是猪的感染率高，仔猪经过一个流行季节几乎100%受到感染，感染后血中病毒数量多，病毒血症时间长，加上猪的饲养面广，更新率快，因此猪（D对）是本病的主要传染源。病毒通常在蚊-猪-蚊等动物间循环。一般在人类乙脑流行前1~2个月，先在家禽中流行，故检测猪的乙脑病毒感染率可预测当年在人群中的流行趋势。